屈腕关节和内收腕关节
A. 肱桡肌
B. 掌长肌
C. 尺侧腕屈肌
D. 拇长伸肌
E. 指浅屈肌

正确答案：C。尺侧腕屈肌

解析：肱桡肌（A错）屈肘关节。掌长肌（B错）屈腕，紧张掌腿膜。尺侧腕屈肌（C对）屈和内收腕，屈肘。拇长伸肌（D错）伸拇指。指浅屈肌（E错）屈2～5指近侧指骨间关节和掌指关节，屈腕和屈肘。